可引起中等量咯血的是
A. 浸润型肺结核
B. 肺淤血
C. 肺囊肿
D. 急性肺水肿
E. 风湿性二尖瓣狭窄

正确答案：E。风湿性二尖瓣狭窄

解析：可引起中等量咯血的是风湿性二尖瓣狭窄（E对）。大量咯血（每日超过500mL）常见于空洞型肺结核、支气管扩张症和肺脓肿。痰中带血多见于浸润性肺结核（A错）。肺淤血有大量粉红色泡沫痰（B错）。肺囊肿破裂可导致咯血后期发展为肺脓肿（C错）。急性肺水肿咳粉红色泡沫样痰（D错）。